患者，女，38岁腰部冷痛重着，天气变化或阴雨风冷时加重治疗除取主穴外，还应选用的穴位是
A. 腰阳关
B. 膈俞
C. 肾俞
D. 次髂
E. 足三里

正确答案：A。腰阳关

解析：患者腰部冷痛重着，天气变化或阴雨风冷时加重可辨证为寒湿腰痛，治疗除主穴外应配腰阳关，以舒筋活络、祛寒除湿、行气止痛（A对）。瘀血腰痛配膈俞（B错）。肾俞为腰痛主穴，可益肾壮腰（C错）。腰骶疼痛配次髎（D错）。足三里为足阳明合穴、胃之下合穴，可扶土而补中气，治疗胃肠病证、下肢痿痹、神志病、乳痈肠痈等外科疾患、虚劳诸证（E错）。